为喷昔洛韦前体药物的是
A. 更昔洛韦
B. 泛昔洛韦
C. 西多福韦
D. 阿德福韦
E. 阿昔洛韦

正确答案：B。泛昔洛韦

解析：本题考查喷昔洛韦的前体药物。泛昔洛韦（B对）是喷昔洛韦的前体药物。泛昔洛韦口服后在体内代谢产生喷昔洛韦。更昔洛韦（A错）、西多福韦（C错）、阿德福韦（D错）、阿昔洛韦（E错）可直接发挥抗病毒作用，非前药。